外表面有的残留橙黄色或棕黄色鳞片状粗皮，纤维性强，难折断，易纵向撕裂的药材是
A. 黄柏
B. 桑白皮
C. 白鲜皮
D. 香加皮
E. 地骨皮

正确答案：B。桑白皮

解析：本题考查的是桑白皮药材的性状鉴别。外表面有的残留橙黄色或棕黄色鳞片状粗皮，纤维性强，难折断，易纵向撕裂的药材是桑白皮（B对）。桑白皮：【性状鉴别】药材呈扭曲的卷筒状、槽状或板片状，长短宽窄不一。外表面白色或淡黄白色，较平坦，有的残留橙黄色或棕黄色鳞片状粗皮；内表面黄白色或淡黄色，有细纵纹。体轻，质韧，纤维性强，难折断，易纵向撕裂，撕裂时有粉尘飞扬。气微，味微甘。黄柏（A错）：【性状鉴别】药材呈板片状或浅槽状，长宽不一。外表面黄棕色或黄褐色，平坦或具纵沟纹，有的可见皮孔痕及残存的灰褐色粗皮；内表面暗黄色或淡棕色，具细密的纵棱纹。体轻，质较硬，断面纤维性，呈裂片状分层，深黄色。气微，味极苦，嚼之有黏性。白鲜皮（C错）：【性状鉴别】药材呈卷筒状。外表面灰白色或淡灰黄色，具细纵皱纹及细根痕，常有突起的颗粒状小点；内表面类白色，有细纵纹。质脆，折断时有粉尘飞扬，断面不平坦，略呈层片状，剥去外层，迎光可见有闪烁的小亮点。有羊膻气，味微苦。香加皮（D错）：【性状鉴别】药材呈卷筒状或槽状，少数呈不规则的块片状。外表面灰棕色或黄棕色，栓皮松软常呈鳞片状，易剥落。内表面黄色或淡黄棕色，较平滑，有细纵纹。体轻，质脆，易折断，断面不整齐，黄白色。有特异的香气，味苦。地骨皮（E错）：【性状鉴别】药材呈筒状或槽状，外表面灰黄色至棕黄色，粗糙，有不规则纵裂纹，易成鳞片状剥落。内表面黄白色至灰黄色，较平坦，有细纵纹。体轻，质脆，易折断，断面不平坦。外层黄棕色，内层灰白色。气微，味微甘而后苦。